龋病导致的牙体硬组织缺损，需进行哪种方式进行治疗
A. 药物治疗
B. 自行修复
C. 充填治疗
D. 再矿化疗法
E. 以上方法均可以

正确答案：C。充填治疗

解析：一旦龋病形成组织缺损应行充填术。掌握“龋病的治疗原则与非手术治疗方法”知识点。